下面说法错误的是
A. 基础毒性又称一般毒性
B. 基础毒性可分为急性、亚急性、亚慢性和慢性毒性作用
C. 研究方法为体外试验
D. 基础毒性是指实验动物单次、多次染毒所产生的总体毒性综合效应
E. 基础毒性是相对特殊毒性而言的

正确答案：C。研究方法为体外试验